《内经》阴阳之道路是
A. 天地
B. 男女
C. 上下
D. 水火
E. 左右

正确答案：E。左右

解析：清代张志聪“东南为左，西北为右，阴阳二气，于上下四旁，昼夜环转，而人之阴阳，亦同天地之气，昼夜循环，故左右为阴阳之道路。”人面南背北而立，左手边是东方，右手边是西方。左是每天太阳升起的方位，而右则是每天太阳落山的方位。从黎明到日暮，太阳自东至西运行，故曰“左右者，阴阳之道路也。”此处太阳就是阳，它的东升西落就有了行动轨迹，称为道路。所以左右，是阴阳的道路（E对）。